属于稳定性高湿试验条件的是
A. 在60℃温度下放置10天
B. 在25℃和相对湿度（90±5）%条件下放置10天
C. 在65℃温度下放置10天
D. 在（4500±500）Lx的条件下放置10天
E. 在（8000±800）Lx的条件下放置10天

正确答案：B。在25℃和相对湿度（90±5）%条件下放置10天

解析：本题考查药物稳定性影响因素试验。稳定性试验包括影响因素试验、加速试验与长期试验。影响因素试验包括高温试验、高湿度试验、强光照射试验。其中高湿度试验：供试品开口置恒温密闭容器中，在25℃置于相对湿度（90±5）%条件下放置10天（B对）。